出生队列分析属于
A. 描述性流行病学方法
B. 分析性流行病学方法
C. 实验性流行病学方法
D. 理论性流行病学方法
E. 观察法与实验法的综合应用

正确答案：A。描述性流行病学方法

解析：本题考查出生队列分析的范畴。出生队列分析是以同一年代的人群组为一个出生队列，对不同的出生队列在不同的年龄阶段某病的发病率、患病率或死亡率的差异分析，归类于描述性研究的范畴，属于描述性流行病学方法（A对BCDE错）。